女，59岁。乏力伴心悸、多汗、手颤、易饿3个月，脾气暴躁。每天大便4～5次，不成形。体重下降6.0kg。查体：甲状腺Ⅱ度肿大、质软，心率110次/分，律齐，心音有力。目前确定诊断的主要检查项目是
A. 口服葡萄糖耐量试验
B. 结肠镜检查
C. 胰岛素释放试验
D. 甲状腺功能测定
E. 甲状腺摄¹³¹I率

正确答案：D。甲状腺功能测定

解析：中年女性患者，出现乏力伴心悸、多汗、手颤、易饿、脾气暴躁、大便次数增多伴腹泻、体重下降（甲状腺功能亢进症典型症状）。甲状腺Ⅱ度肿大、心率快、心音有力（甲状腺功能亢进症典型体征），考虑诊断为甲状腺功能亢进症。引起甲亢一系列临床表现的关键为血液循环中甲状腺激素过多，作用于全身各系统引起其兴奋性增高和代谢亢进，因此其诊断首选血甲状腺素水平测定（D对）。口服葡萄糖耐量试验（A错）用于检测葡萄糖耐量，是糖尿病及糖尿病前期的重要检查。胰岛素释放试验（C错）多用于糖尿病的诊断。结肠镜检查（B错）主要用于诊断结直肠病变，如溃疡性结肠炎、结直肠癌等。甲状腺摄¹³¹I率（E错）现已被sTSH（敏感TSH）测定技术所代替，临床上少用。